某患儿，7岁，行为刻板重复，智力低下，与他人存在交流障碍，但无认知-语言发有障碍。该病属于哪种心理-行为问题
A. 顽固性不良习惯
B. 情绪问题
C. 学业相关问题:
D. 品行问题
E. 广泛性发育障碍

正确答案：E。广泛性发育障碍